《医疗机构制剂配制质量管理规范（试行）》中规定的“一批”是指
A. 具有同一性质和质量并连续生产出来的药品
B. 具有同一性质和质量并在同一容器中制备出来的制剂
C. 在同一配制周期中制备出来的一定数量常规配制的制剂
D. 具有均质性并在一定配制时间中制备出来的制剂
E. 具有均质性并有一定数量的常规配制制剂

正确答案：C。在同一配制周期中制备出来的一定数量常规配制的制剂